制备缓释固体分散物应首选的载体材料是
A. PLA
B. PVA
C. PVP
D. EC
E. HPMCP

正确答案：D。EC

解析：本题考查缓释固体分散体常用的载体材料。缓释型固体分散物系指药物分散在难溶性骨架材料中缓慢非恒速地释放药物的固体分散物。乙基纤维素（EC）（D对）为不溶性骨架材料，可作为缓释型固体分散物的载体材料使药物缓慢释放，也可作为速释载体材料。PLA（聚乳酸）（A错）常用作缓释骨架材料、微囊囊膜材料和微球成球体材料。PVA（聚乙烯醇）（B错）和PVP（聚维酮）（C错）为亲水凝胶骨架材料。HPMCP（羟丙甲纤维素酞酸醋）（E错）为肠溶性包衣材料。